将细胞因子基因导入体内，使之发挥免疫调节作用。通过直接抑制肿瘤细胞生长或间接激活抗肿瘤免疫功能等机制达到治疗肿瘤目的的方法是
A. 基因治疗
B. 过继免疫治疗
C. 主动特异性免疫治疗
D. 免疫导向治疗
E. 以上都不是

正确答案：A。基因治疗